能够根据组织排列结构不同分为混合型和组合型的成牙组织的错构瘤是
A. 牙瘤
B. 成釉细胞纤维瘤
C. 骨化纤维瘤
D. 正中囊肿
E. 腺样囊性癌

正确答案：A。牙瘤

解析：牙瘤为成牙组织的错构瘤或发育畸形，根据牙体硬组织的排列结构不同，可以分为混合型牙瘤和组合型牙瘤。掌握“骨化纤维瘤”知识点。